右心室入口处有
A. 主动脉瓣
B. 肺动脉瓣
C. 二尖瓣
D. 三尖瓣
E. 下腔静脉瓣

正确答案：D。三尖瓣

解析：右心室入口处有三尖瓣（D对）附着于右房室口的三尖瓣环上。